李某，女，30岁。平素体壮，便秘，数日一行，需服用泻药，大便干结，腹部胀满，烦热口渴，口臭，舌红，苔黄厚，脉滑数，宜选方
A. 润肠丸
B. 济川煎
C. 麻子仁丸
D. 大承气汤
E. 五仁丸

正确答案：C。麻子仁丸

解析：题中患者为便秘，平素体壮，数日一行，故为实秘。胃为水谷之海，肠为传导之官，若肠胃积热，耗伤津液，则大便干结；热积肠胃，腑气不通，则腹部胀满；热伏于内，脾胃之热熏蒸于上，故烦热口渴，口臭；舌红，苔黄厚为热已伤津，脉滑数为里实之征，故诊断为热秘，治疗应用泻热导滞，润肠通便的麻子仁丸（C对）。润肠丸养血润燥，为血虚秘的代表方（A错）。济川煎温阳通便，为阳虚秘的代表方（B错）。大承气汤峻下热结，主治阳明腑实证，热结旁流，里热实证之热厥、痉病或发狂等（D错）。五仁丸润肠通便，主治津枯肠燥证（E错）。